下列穴位，归属于足太阳膀胱经的是
A. 大杼
B. 大包
C. 大巨
D. 大敦
E. 大椎

正确答案：A。大杼

解析：大杼属足太阳膀胱经（A对）。大包属足太阴脾经（B错）。大巨属足阳明胃经（C错）。大敦属足厥阴肝经（D错）。大椎属督脉（E错）。